甲状舌管始于
A. 胚胎第3周
B. 胚胎第4周
C. 胚胎第5周
D. 胚胎第6周
E. 胚胎第7周

正确答案：B。胚胎第4周

解析：胚胎第4周，奇结节和联合突之间中线处的表面内胚层上皮向深部增生，形成管状上皮条索，称甲状舌管。掌握“腭部与舌的发育”知识点。